前庭窗位于
A. 颈静脉壁
B. 颈动脉壁
C. 乳突壁
D. 迷路壁
E. 附着在卵圆窗上

正确答案：D。迷路壁

解析：迷路壁（D对）即内侧壁，其中部有圆形的隆起称岬。岬的后上方有一卵圆形小孔，称前庭窗或卵圆窗。